下列哪项是燥邪犯肺证与肺阴虚证的鉴别要点
A. 有无发热恶寒
B. 有无胸痛咳血
C. 有无口干咽燥
D. 痰量的多少
E. 咯痰的难易

正确答案：A。有无发热恶寒

解析：燥邪犯肺证与肺阴虚证的主要区别在于有无表证，发热恶寒属表症症状故选项A正确（A对）。两证均因肺津耗伤，肺失滋润，则均有胸痛咳血症状（B错）。两证均肺津受损，故可共有口干咽燥的症状（C错）。两证均有干咳无痰或痰少而黏的症状，故两证痰量都很少（D错）。两证肺失滋润，清肃失职，故均痰少难咯（E错）。